在快速眼动睡眠期（REM）出现焦虑恐惧的梦境体验，伴有惊恐情绪，以及心跳加速、呼吸急促、出汗等自主精神症状，醒后或次晨能清晰回忆。可诊断为
A. 失眠症
B. 睡行症
C. 睡眠呼吸暂停综合征
D. 夜惊
E. 梦魇

正确答案：E。梦魇

解析：患者在快速眼动睡眠期（REM）出现焦虑恐惧的梦境体验（处于危险境地），伴有惊恐情绪，以及心跳加速，呼吸急促，出汗等自主精神症状，醒后或次晨能清晰回忆（醒来能回忆梦境恐怖内容）为梦魇（E对）。睡行症（梦游症）患者表现为睡眠过程尚未清醒时起床在室内或户外行走，或做一些简单活动的睡眠和清醒的混合状态，与本例不符（B错）。夜惊发生于非快速眼动期（NREM）睡眠，清醒后对夜间发作不能回忆，不能说出梦境内容，与本例不符（D错）。